分子中含有易离子化的羧基，不易通过血脑屏障的非镇静性抗组胺药物是
A. 地氯雷他定
B. 马来酸氯苯那敏
C. 盐酸西替利嗪
D. 盐酸赛庚啶
E. 盐酸苯海拉明

正确答案：C。盐酸西替利嗪

解析：本题考查非镇静性抗组胺药。盐酸西替利嗪（C对）分子中含有羧基, 易离子化，不易通过血脑屏障，是非镇静性抗组胺药。地氯雷他定（A错）为非镇静性抗组胺药，但其分子中不含有羧基。马来酸氯苯那敏（B错）、盐酸赛庚啶（D错）和盐酸苯海拉明（E错）是经典的H₁受体拮抗剂。